身常汗出，夜卧尤甚，久而不止，心悸惊惕，短气烦倦者，治疗应选用
A. 牡蛎散
B. 归脾汤
C. 补中益气汤
D. 四物汤
E. 黄土汤

正确答案：A。牡蛎散

解析：本证因卫外不固，阴液损伤，心阳不潜所致。卫气虚，卫外不固，腠理疏松，津液外泄则自汗；汗为心液，汗出过多，心明不足，心阳不潜，虚热内生，阴津外泄，故汗出、夜卧更甚；汗出日久，心之气阴耗伤，心神失养，则见心悸易惊、烦倦短气，应用敛阴止汗，益气固表的牡蛎散治疗（A对）。归脾汤（B错）的功用为益气补血，健脾养心，主治心脾气血两虚证；脾不统血证。补中益气汤（C错）的功用为补中益气，升阳举陷，主治脾胃气虚证，或气虚下陷证，或气虚发热证。四物汤（D错）的功用为补血和血，主治营血虚滞证；黄土汤（E错）的功用为温阳健脾，养血止血，主治脾阳不足，脾不统血证。